颌面骨中容易发生骨折的为
A. 颧骨
B. 颧弓
C. 腭骨
D. 下颌骨
E. 上颌骨

正确答案：D。下颌骨

解析：下颌骨占据面下1/3部及面侧面中1/3的一部分，位置突出，易遭受损伤而导致骨折发生率高。掌握“牙槽突骨折、颌骨骨折”知识点。